根据生理效应，肾上腺素受体分为α受体和β受体，受体分为α₁、α₂等亚型，β受体分为β₁、β₂等亚型。α₁受体的功能主要为收缩血管平滑肌，增强心肌收缩力；α₂受体的功能主要为抑制心血管活动，抑制去甲肾上腺素、乙酰胆碱和胰岛素的释放，同时也具有收缩血管平滑肌作用。β₁受体的功能主要为增强心肌收缩力，加快心率等；β₂受体的功能主要为松弛血管和支气管平滑肌。胰岛细胞上的β受体属于β₂亚型，根据肾上腺素受体的功能分析，对于合并糖尿病的室上性心动过速患者，宜选用的抗心律失常药物类型是
A. 选择性β₁受体阻断药
B. 选择性β₂受体阻断药
C. 非选择性β受体阻断药
D. β₁受体激动药
E. β₂受体激动药

正确答案：A。选择性β₁受体阻断药

解析：本题考查抗心律失常药。对于合并糖尿病的室上性心动过速患者，宜选用的抗心律失常药物类型是选择性β₁受体阻断药（A对）。胰岛细胞中β细胞属于β₂亚型，约占胰岛细胞的60%～80%。胰岛β细胞分泌胰岛素，胰岛素可以降低血糖。缺乏胰岛β细胞将导致糖尿病发生。因此，合并糖尿病的室上性心动过速患者，不应使用选择性β₂受体阻断药和非选择性β受体阻断药治疗室上性心动过速，会阻断胰岛β细胞分泌胰岛素致使糖尿病加重。